与敏感菌核蛋白体结合阻断转肽作用和mRNA位移的药物是
A. 磺胺嘧啶
B. 氧氟沙星
C. 利福平
D. 两性霉素
E. 红霉素

正确答案：E。红霉素

解析：本题考查红霉素的作用机制。红霉素（E对）与敏感菌核蛋白体结合，竞争性阻断了肽链延伸过程中的转肽作用和mRNA位移。磺胺嘧啶（A错）与PABA竞争二氢叶酸合成酶，阻止二氢叶酸的合成，RNA和DNA合成受阻，最终抑制细菌生长繁殖。氧氟沙星（B错）用于治疗细菌性结膜炎、角膜炎、角膜溃疡、泪囊炎、术后感染等外眼感染。利福平（C错）能特异性抑制敏感微生物的DNA依赖性RNA聚合酶，阻碍其mRNA的合成。两性霉素B（D错）能够改变细胞膜的通透性，可引起细胞内重要物质的外漏，无用物或对其有毒物质内渗而致真菌死亡。